血瘀阻于肝的主要症状是
A. 痛经
B. 闭经
C. 胁痛痞块
D. 呃逆呕血
E. 崩漏经多

正确答案：C。胁痛痞块

解析：本题考查的是瘀血的致病特点。血瘀阻于肝，可见胁痛痞块（C对）。瘀血的致病特点：（1）疼痛：多为刺痛，痛处固定不移，拒按，夜间痛甚。（2）肿块：外伤肌肤局部，可见青紫肿胀；积于体内，久聚不散，则形成癥积，按之有痞块，固定不移。（3）出血：血色多呈紫暗色，并伴有血块。另外，临床望诊，往往还可见到面色黧黑、肌肤甲错、唇甲青紫、舌色紫暗或有瘀点、瘀斑，或舌下静脉曲张等表现。切诊则多见细涩、沉弦或结代等脉象。瘀血阻滞不同部位，出现症状各异。例如，瘀阻于心，可见心悸、胸闷心痛、口唇指甲青紫；瘀阻于肺，可见胸痛、咯血；瘀阻胃肠，可见呕血（D错）、大便色黑如漆；瘀阻于肝，可见胁痛痞块；瘀血攻心，可致发狂；瘀阻胞宫，可见少腹疼痛、月经不调、痛经（A错）、闭经（B错）、经色紫暗成块，或见崩漏（E错）；瘀阻于肢体末端，则可形成脱骨疽；瘀阻肢体肌肤局部，则可见局部肿痛青紫等。